小儿能独走的时间一般是
A. 8个月
B. 10个月
C. 12个月
D. 16个月
E. 18个月

正确答案：C。12个月

解析：考题考查小儿的运动发育。小儿8个月会爬（A错），10个月可扶走（B错），12个月能独走（C对），16个月无明显特点（D错），18个月可跑步和倒退行走（E错）。